女，45岁。月经不规律1年余，阴道不规则流血20天。高血压病史10年，服药后血压控制良好。1年前体检查HPV（-），已绝育。妇科检查：子宫正常大小，稍软，无压痛，宫旁未触及异常。为明确诊断，首选的检查是
A. 阴道镜检查
B. B超
C. 盆腔MRI
D. 分段诊刮
E. TCT

正确答案：D。分段诊刮

解析：围绝经期女性患者（功血好发于绝经过渡期女性），月经不规律1年余，阴道不规则流血20天（功血最常见的临床表现：月经周期紊乱，经期延长等）。高血压病史10年，服药后血压控制良好。1年前体检查HPV（-）（排除宫颈癌，HPV与子宫颈癌、尖锐湿疣发生密切相关），已绝育。妇科检查：子宫正常大小，稍软，无压痛，宫旁未触及异常（初步排除器质性病变可能），根据以上临床表现及相关辅助检查，初步考虑拟诊为：功能失调性子宫出血（简称功血），为明确诊断应行分段诊刮（D对）。阴道镜检查（A错）（P443）适用于宫颈细胞学检查及HPV DNA阳性者，放大直接观察阴道和宫颈血管形态和上皮结构，以发现与癌变有关的异型上皮及血管，并对可疑部位定位活检以提高宫颈疾病确诊率。B超（B错）主要用于明确有无宫腔占位病变及其它生殖道器质性病变，不用于功血确诊。盆腔MRI（C错）（P439）主要用于妇科肿瘤的诊断和手术前的评估，尤其适合盆腔病灶定位及病灶与相邻结构关系的确定。TCT（新柏氏液基细胞学技术）（E错）是一种宫颈病变筛查技术。